不属于肿瘤的免疫防治是
A. 肿瘤的免疫预防
B. 被动输注抗体的肿瘤免疫治疗
C. 细胞因子治疗
D. 活化B细胞免疫治疗
E. 肿瘤治疗性疫苗

正确答案：D。活化B细胞免疫治疗